颞下颌关节关节囊的上后方附着于
A. 颧弓
B. 蝶骨嵴
C. 鼓鳞裂
D. 岩鼓裂
E. 岩鳞裂

正确答案：C。鼓鳞裂

解析：本题考查颞下颌关节-关节囊。颞下颌关节关节囊的上后方附着于鼓鳞裂（C对）。颞下颌关节由上方的颞骨关节窝和关节结节（两者合称颞骨关节面）、下方的下颌骨髁突、居于两者之间的关节盘，以及其外侧包绕的关节囊和囊内外韧带等部分构成。其中关节囊由韧性较强的纤维结缔组织构成，呈袖套状，上前方附着于关节结节前斜面的前缘，上后方附着于鼓鳞裂及岩鳞裂的前方，内外侧附着于关节窝的边缘；关节囊连于关节盘的周缘后，向下附着于髁突颈部。正常情况下，髁突及关节盘的运动均受到关节囊包被与限制。